维持情志活动正常的主要脏腑是
A. 肝与肺
B. 脾与胃
C. 心与肝
D. 肺与心
E. 肾与膀胱

正确答案：C。心与肝

解析：本题考查的是心与肝的关系。维持情志活动正常的主要脏腑是心与肝（C对）。心与肝的关系主要表现在血液与神志方面的依存与协同。1.血液运行：血液贮藏于肝，通过心气推动作用而运行于全身。心行血功能正常，肝有所藏。若肝不藏血，则心无所主，血液的运行必致失常。故“心肝血虚”常同时出现。2.神志活动：心主神明，肝主疏泄。人的意识、思维、情志等精神活动，虽由心所主，但与肝的疏泄功能亦密切相关，故心、肝病变亦都可表现为神志活动的异常。肝与肺（A错）的关系，主要表现于气机的调节。肺主降而肝主升，二者相互协调，对于全身气机的调畅是一个重要的环节。若肝升太过，或肺降不及，则多致气火上逆，可出现咳逆上气、甚则咯血等病变表现，称之为“肝火犯肺”。脾与胃（B错）通过经脉相互络属而构成表里关系。脾与胃的相互配合，主要体现在三个方面：1.纳运协调：脾主运化，胃主受纳，一纳一运，相互协调配合，共同完成饮食物的消化吸收及其精微的输布，以营养全身。2.升降相因：脾气主升，胃气主降，一升一降，相互协调。3.燥湿相济。心与肺（D错）的关系，主要表现在心主血与肺主气、心主行血与肺主呼吸之间的关系。肺主气，具有助心行血之作用。肺气正常则是血液正常循行的必要条件。心主血，推动血液循行，方能维持肺呼吸功能的正常进行，故有“呼出心与肺”之说。联结心之搏动和肺之呼吸两者之间的中心环节是积于胸中的“宗气”。由于宗气具有贯心脉而行气血，走息道而司呼吸的生理功能，从而加强了血液循环与呼吸运动之间的相互联系，以及在病变上的相互影响。肾与膀胱（E错）通过经脉相互络属，构成表里关系。膀胱的贮尿和排尿功能，均依赖于肾的气化。肾气充足，则固摄有权，膀胱开合有度，以维持津液的正常代谢。在病变方面，肾的功能失常，常会影响到膀胱。例如，肾气虚衰，固摄无权，则膀胱开合无度，可见尿频、小便清长、遗尿，甚或尿失禁等；若肾阳虚衰，肾与膀胱气化不利，可见小便不利，甚或癃闭等。